牙骨质可以随着牙周膜纤维的改变和更替不断沉积，形成
A. 继发性牙骨质
B. 无细胞牙骨质
C. 细胞牙骨质
D. 新生牙骨质
E. 继发性牙本质

正确答案：A。继发性牙骨质

解析：当牙周膜的纤维因适应牙齿功能的需要发生改变和更替时，牙骨质可通过不断的增生沉积而形成继发性牙骨质。掌握“牙骨质”知识点。